充血性心力衰竭加重期出现少尿，血BUN/Cr＞20，尿比重1.028，最可能的诊断是
A. 肾后性急性肾衰竭
B. 肾前性急性肾衰
C. 急性肾小管坏死
D. 急进性肾炎
E. 急性间质性肾炎

正确答案：B。肾前性急性肾衰

解析：肾前性急性肾衰由肾脏血流灌注不足导致，诊断标准中包括：尿比重＞1.020；血BUN/Cr：＞20。尿比重＞1.020是由于GFR虽降低，但肾前性肾衰竭因肾小管的重吸收功能正常，且因有效循环血量不足，导致ADH分泌增多，导致水钠重吸收增多，尿比重升高。血BUN/Cr：＞20是由于GFR降低致原尿生成减少，尿素氮及肌酐滤过均减少，但尿素氮可以肾小球滤过，可以肾小管回吸收；肌酐可以滤过，但不可以回吸收，故血尿素氮（BUN）及肌酐（Cr）增高不成比例，且因原尿生成减少，原尿在肾小管中流速减慢，导致肾小管对尿素氮回吸收增加，血尿素氮进一步升高。充血性心力衰竭加重期（提示心排出量严重不足）出现少尿（提示肾灌注不足或肾功能受损），血BUN/Cr＞20，尿比重1.028，符合肾前性肾衰竭（B对）的诊断标准。肾后性急性肾衰竭（A错）常由尿路梗阻引起，患者并没有相关病史及症状。急性肾小管坏死（C错）是肾前性急性肾衰竭的进展，表现为尿比重＜1.010，BUN/Cr＜10～15，与患者相关检查不符。急进性肾炎（D错）常有前驱感染史，表现为急性肾炎综合征，患者并没有相关症状。急性间质性肾炎（E错）常因药物及过敏所致，主要表现为肾小管功能受损，出现肾性糖尿、低比重尿及低渗透压尿，与患者相关症状不符。